导致再生障碍性贫血的抗菌药有
A. 青霉素
B. 氯霉素
C. 甲砜霉素
D. 头孢呋辛
E. 红霉素

正确答案：B、C。氯霉素；甲砜霉素

解析：本题考查药物的不良反应。氯霉素（B对）及甲砜霉素（C对）属酰胺醇类抗菌药物，其典型不良反应为对骨髓造血功能抑制，表现为再生障碍性贫血。